善于治疗呃逆的腧穴是
A. 外关
B. 照海
C. 攒竹
D. 承山
E. 太溪

正确答案：C。攒竹

解析：呃逆是指胃气上逆动膈，以气逆上冲，喉间呃呃连声，不能自制为主要表现的病证，当治以宽胸利膈，和胃降逆，宜以任脉、手厥阴心包经、足阳明胃经经穴为主。但是，足太阳膀胱经之攒竹亦对呃逆症状具有相对特异的治疗作用（C对）。